某男，60岁。5年前被确诊为支气管哮喘，多在夜间发作。发作时顿感胸部胀闷，呼吸困难（呼气延长）并伴有哮鸣音、干咳和紫绀。为减轻气喘，常被迫坐起，经西医治疗，症情缓解。为进一步缓解病情遂请中医诊治。因煎药不便，希望服用中成药。7日后，患者再来就诊。诉云：服药后虽由黄稠痰转为灰白稀痰，大便由秘结转为通畅，但仍咳嗽痰多、气逆喘促。医师诊断为痰浊阻肺，宜选用的中成药是
A. 清肺抑火丸
B. 降气定喘丸
C. 礞石滚痰丸
D. 止嗽定喘口服液
E. 通宣理肺丸

正确答案：B。降气定喘丸

解析：本题考查的是降气定喘丸的主治。咳嗽痰多、气逆喘促，诊断为痰浊阻肺，宜选用的中成药是降气定喘丸（B对）。降气定喘丸：【主治】痰浊阻肺所致的咳嗽痰多，气逆喘促；慢性支气管炎、支气管哮喘见上述证候者。清肺抑火丸（A错）：【主治】痰热阻肺所致的咳嗽、痰黄黏稠、口干咽痛、大便干燥。礞石滚痰丸（C错）：【主治】痰火扰心所致的癫狂惊悸，或喘咳痰稠、大便秘结。止嗽定喘口服液（D错）：【主治】表寒里热，身热口渴，咳嗽痰盛，喘促气逆，胸膈满闷；急性支气管炎见上述证候者。通宣理肺丸（E错）：【主治】风寒束表、肺气不宣所致的感冒咳嗽，症见发热、恶寒、咳嗽、鼻塞流涕、头痛、无汗、肢体酸痛。